患儿，5岁。2周前曾患感冒，现觉乏力，时有胸痛，间见憋气，纳差便调，咽红咳嗽，苔黄，脉数。治疗应首选的方剂是
A. 生脉散
B. 银翘散
C. 失笑散
D. 桂枝甘草龙骨牡蛎汤
E. 葛根黄芩黄连汤

正确答案：B。银翘散

解析：患儿感冒，现觉乏力，时有胸痛，间见憋气，纳差便调，咽红咳嗽，苔黄，脉数。诊断为风热感冒，风热之邪，侵犯肺卫，邪在卫表，卫气不畅，则致发热较重、恶风、微有汗出；风热之邪上扰，则头痛；热邪客于肺卫，肺气失宣，则致鼻塞、流浊涕、喷嚏、咳嗽；咽喉为肺胃之门户，风热上乘咽喉，则致咽喉肿痛等证候（B对）。生脉散主治温热、暑热、耗气伤阴证。汗多神疲，体倦乏力，气短懒言，咽干口渴，舌干红少苔，脉虚数（A错）。失笑散主治瘀血停滞证。心腹刺痛，或产后恶露不行，或月经不调，少腹急痛等（C错）。病毒性心肌炎心阳虚弱证用桂枝甘草龙骨牡蛎汤（D错）。葛根黄芩黄连汤主治外感表证未解，热邪入里，身热，下利臭秽，肛门有灼热感，心下痞，胸脘烦热，喘而汗出，口干而渴，苔黄，脉数（E错）。